后牙3/4冠与前牙3/4冠在牙体预备中的主要不同是
A. （牙合）面沟与切端沟
B. 邻轴沟方向
C. 邻轴沟深度
D. 邻轴沟形态
E. 邻轴沟位置

正确答案：A。（牙合）面沟与切端沟

解析：本题考查后牙3/4冠与前牙3/4冠在牙体预备中的不同。前牙3/4冠切端沟在切端靠近舌侧呈V型，接近近远中轴沟，唇侧与舌侧宽度之比2：1；后牙3/4冠（牙合）面沟在颊尖的舌斜面呈V型，舌侧壁可短于颊侧壁，两者稍有不同（A对）。两者的邻轴沟方向都要求和部分冠的就位道一致（B错）；深度在龈端为1mm，在（牙合）面或切端稍浅，长约4mm，止于外形线上0.5mm（C错）；形态要求舌侧壁与邻面呈直角，唇颊壁稍外展，预备竖斜面（D错）；位置一般位于唇颊轴线角与颊侧接触点之间（E错）。